呈丝片状，上表面绿色、黄绿色或浅黄色，下表面灰绿色，网脉明显，近革质，气微，味微苦的饮片是
A. 淫羊藿
B. 大青叶
C. 紫苏叶
D. 枇杷叶
E. 蓼大青叶

正确答案：A。淫羊藿

解析：本题考查的是淫羊藿饮片的性状鉴别。呈丝片状，上表面绿色、黄绿色或浅黄色，下表面灰绿色，网脉明显，近革质，气微，味微苦的饮片是淫羊藿（A对）。淫羊藿：【性状鉴别】饮片呈丝片状。上表面绿色、黄绿色或浅黄色，下表面灰绿色，网脉明显，中脉及细脉凸出，边缘具黄色刺毛状细锯齿。近革质。气微，味微苦。大青叶（B错）：【性状鉴别】饮片为不规则的碎段。叶片暗灰绿色，叶上表面有的可见色较深稍突起的小点；叶柄碎片淡棕黄色。质脆。气微，味微酸、苦、涩。紫苏叶（C错）：【性状鉴别】饮片呈不规则的段或未切叶。叶多皱缩弯曲、破碎，完整者展平后呈卵圆形。边缘具圆锯齿。两面紫色或上表面绿色，下表面紫色，疏生灰白色毛。叶柄紫色或紫绿色。气清香，味微辛。枇杷叶（D错）：【性状鉴别】饮片呈丝条状，表面灰绿色、黄棕色或红棕色，较光滑，下表面可见绒毛，主脉突出。革质而脆。气微，味微苦。蓼大青叶（E错）：【性状鉴别】药材叶多皱缩、破碎。完整者展平后呈椭圆形，蓝绿或蓝黑色，先端钝，基部渐狭，全缘。叶脉浅黄棕色，于下表面略突起。叶柄扁平，偶带膜质托叶鞘。质脆。气微，味微涩而稍苦。